余邪留伏发热的特点是
A. 夜热早凉
B. 日晡潮热
C. 持续高热
D. 骨蒸发热
E. 身热不扬

正确答案：A。夜热早凉

解析：夜热早凉，提示邪热伏于阴分，卫阳之气，日行于表，而夜入于里，入夜则阳气入阴，与阴分之伏热，两阳相加，而身热；平旦卫气行于表，阳出于阴，则热退身凉（A对）。日晡潮热，大便干结属阳明潮热，常见于伤寒之阳明腑实证（B错）。壮热指高热（体温在39℃以上）持续不退，不恶寒只恶热的症状，常见于伤寒阳明经证或温病气分证（C错）。骨蒸潮热多属阴虚火旺所致（D错）。因湿邪黏腻，湿遏热伏，故身热不扬，常见于湿温病（E错）。